符合桩冠的适应证的是
A. 根管壁侧穿
B. 已作根管治疗，瘘管口未闭
C. 作固定义齿基牙的残冠残根
D. 前牙斜折达根中1/3者
E. 根管弯曲细小

正确答案：C。作固定义齿基牙的残冠残根

解析：本题考查桩核冠的适应证及临床注意事项。符合桩冠的适应证的是作固定义齿基牙的残冠残根（C对）。当剩余的可利用牙体组织高度不足，无法形成足够的全冠固位形时，通常需要桩核来为最终的修复体提供支持和固位，即桩核冠。残冠残根固位力不足，需要桩核来提供支持和固位，故适用于桩核冠修复。根管壁侧穿（A错）不影响牙的固位，不适用桩核冠修复。已作根管治疗，瘘管口未闭（B错）者，应先处理瘘管口，否则微生物可经此途径侵入根尖周组织。前牙斜折达根中1/3者（D错），当因治疗需要将根尖部断块用手术方法去除后，因冠侧段过短而支持不足时，常需插入钛合金根管骨内种植体以恢复牙原有的长度，不适用桩核冠修复。根管弯曲细小（E错）者，可能无法提供足够的空间与长度来容纳桩核，不适用桩核冠修复。